男，35岁。因5天来右下后牙肿痛，今日全身不适来就诊。查患者痛苦面容，右面颊部肿胀较明显。右下第一前磨牙远中颈部龋深穿髓，无探痛，Ⅲ度松动，叩痛（+++），龈红肿明显，移行沟变平。扪诊牙龈肿胀有波动感的方法是
A. 棉球口内扪诊
B. 单指口内扪诊
C. 二指口内扪诊
D. 二指口外扪诊
E. 双手口外扪诊

正确答案：B。单指口内扪诊

解析：本题考查扪诊检查方法。判断口内黏膜脓肿的波动感时，单指扪诊（B对）即可，避免临床检查过分挤压脓腔。用单个食指，应戴指套，动作要轻柔。棉球扪诊（A错）多用镊子夹持棉球触压牙龈，观察龈沟处是否有脓液或血液溢出，以了解牙周炎症的情况。双指双合诊（CD错）多用于唇颊舌部检查。双手口外扪诊（E错）适用于口底、下颌下检查。